低张性缺氧引起肺通气量增加的主要机制是
A. 刺激颈动脉窦和主动脉弓的压力感受器
B. 刺激颈动脉体的化学感受器
C. 直接刺激呼吸中枢
D. 刺激肺牵张感受器
E. 刺激交感神经末稍感受器

正确答案：B。刺激颈动脉体的化学感受器

解析：低张性缺氧时，动脉血氧分压降低，刺激颈动脉体和主动脉体化学感受器（B对），反射性兴奋呼吸中枢，使呼吸加深加快，肺泡通气量增加。刺激颈动脉窦和主动脉弓的压力感受器（A错）、直接刺激呼吸中枢（C错）、刺激肺牵张感受器（D错）、刺激交感神经末稍感受器（E错）都不是低张性缺氧引起肺通气量增加的主要机制。